管理舌前2/3味觉的神经是
A. 三叉神经
B. 面神经
C. 舌咽神经
D. 迷走神经
E. 舌下神经

正确答案：B。面神经

解析：面神经（B对）的感觉纤维为中间神经，终止于舌前2/3味蕾，司舌前2/3味觉。三叉神经（A错）为混合神经感觉神经司面部、口腔及头顶部的感觉。舌咽神经（C错）周围突分布于舌后1/3味蕾，传导味觉。迷走神经（D错）周围突分布于外耳道、耳廓凹面的一部分皮肤（耳支）及硬脑膜。舌下神经（E错）为躯体运动神经，支配舌肌运动。